风心病，心功能Ⅲ级妇女患右侧输卵管妊娠破裂，手术应行
A. 右附件切除
B. 右附件切除，左侧输卵管结扎
C. 右侧输卵管切除
D. 子宫次全切除加右附件切除
E. 右输卵管切除，左输卵管结扎

正确答案：E。右输卵管切除，左输卵管结扎

解析：本题考查异位妊娠。输卵管妊娠破裂，需要将患侧输卵管切除；目前患者风心病，心功能Ⅲ级，不适合妊娠，所以，需要行健侧输卵管结扎，即右输卵管切除，左输卵管结扎（E对）。